生后4个月开始
A. 发出喉音
B. 咿呀发音
C. 能懂“再见”
D. 开始用单词
E. 能说出自己的名字

正确答案：B。咿呀发音

解析：2个月发喉音，3～4个月咿呀发音。掌握“运动和语言发育”知识点。